患儿，11岁。入院时诊断为腺病毒肺炎，今突然面色发灰，口唇发绀，烦躁不安。查体：呼吸60次/分，心率168次/分，心音低钝，右胁下痞块。舌质略紫，脉细弱。在抗心衰治疗的同时应首选的方剂是
A. 参附龙牡救逆汤
B. 麻杏石甘汤
C. 羚角钩藤汤
D. 独参汤
E. 真武汤

正确答案：A。参附龙牡救逆汤

解析：根据患儿于肺炎病程中出现面色发灰，口唇发绀，烦躁不安，结合查体，故诊断为重症肺炎合并心力衰竭，西医治疗为主要镇静、给氧、增强心肌收缩力（西地兰等），减慢心率，增加心搏出量，减轻心脏负荷。心阳虚衰，气滞血瘀，故见面色发灰，口唇发绀，烦躁不安；邪气闭郁，气郁血滞，而肝为藏血之脏，血滞则瘀郁，故见肝大；脉通于心，心阳虚衰，推动无力，故见脉数，心音低钝，故在肺炎喘嗽的基础上形成心阳虚衰证，治以温补心阳，救逆固脱，方药为参附龙牡救逆汤，故在抗心衰治疗的同时应首选的方剂是参附龙牡救逆汤（A对）。麻杏石甘汤（B错）其功用为辛凉疏表，清肺平喘，与银翘散合用适用于肺炎之风热闭肺证。羚角钩藤汤（C错）其功用为凉肝熄风，增液舒筋，与牛黄清心丸合用，适用于肺炎哮喘之变证邪陷厥阴。独参汤（D错）其功用为大补元气，适用于元气虚脱证。真武汤（E错）其功用为温阳利水，适用于阳虚水泛证。